口腔颌面部脓肿形成后，主要的治疗措施是
A. 大剂量抗生素
B. 对症治疗
C. 大剂量激素
D. 脓肿切开引流和应用抗生素
E. 局部外敷中药

正确答案：D。脓肿切开引流和应用抗生素

解析：本题考查口腔颌面部脓肿形成后的治疗措施。口腔颌面部脓肿已经形成脓肿或脓肿已经破溃但引流不畅者，必须切开引流，以减轻局部压力，阻止炎症继续扩散。同时应用抗生素预防感染（D对）。大剂量应用抗生素易引起菌群失调（A错），抗生素的量应按各种抗菌药物的治疗剂量范围给药。大剂量激素是短期内迅速控制病情恶化的方法，不适用于颌面部脓肿（C错）。局部外敷中药（E错）及全身的对症治疗（B错）只可用来作为辅助手段。